医疗机构在使用某企业生产的甲氨蝶呤注射液时发现药液内存在玻璃屑应采取的措施是
A. 继续使用并通知供应商
B. 立即停止使用并主动召回
C. 及时向药品不良反应监测机构报告
D. 立即停止使用并销毁，并向药品监督管理部门报告
E. 立即停止使用、就地封存，并向药品监督管理部门报告

正确答案：E。立即停止使用、就地封存，并向药品监督管理部门报告

解析：本题考查药品管理。《药品召回管理办法》第六条规定，药品经营企业、使用单位发现其经营、使用的药品存在安全隐患的，应当立即停止销售或者使用该药品，通知药品生产企业或者供货商，并向药品监督管理部门报告（E对）。